翼腭间隙的叙述中，正确的描述是
A. 间隙内有上颌神经
B. 向前经眶下裂通眼眶
C. 间隙内有蝶腭神经节
D. 向内经蝶腭孔通鼻腔
E. 以上均正确

正确答案：E。以上均正确

解析：翼腭间隙（翼腭窝）位于眶尖的下方、颞下窝的内侧。前界为上颌骨体部，后界为蝶骨翼突，上为蝶骨大翼，内以腭骨垂直板为界。间隙内主要有上颌神经、蝶腭神经节、上颌动脉及其分支。翼腭间隙向前经眶下裂通眼眶，向内经蝶腭孔通鼻腔，向外经翼上颌裂通颞下间隙，向下经翼腭管通口腔，向后上经圆孔通颅腔。掌握“面侧深区及颌面部各间隙的境界”知识点。